成人心肺复苏抢救时胸外按压与人工呼吸通气的比例
A. 15：2
B. 30：2
C. 10：2
D. 5：2
E. 40：2

正确答案：B。30：2

解析：根据2010年AHA复苏指南：心脏按压与人工呼吸比为30：2（B对），直到人工气道的建立。